适用于种植义齿印模制取的材料为
A. 琼脂类
B. 藻酸盐类
C. 聚醚橡胶类
D. A型硅橡胶
E. 缩合型硅橡胶

正确答案：C。聚醚橡胶类

解析：聚醚橡胶类。优点：表面清晰度和尺寸稳定性均优异；亲水。缺点：味苦；聚合后硬度高，脱模不易；易吸水变形。由于聚合后硬度高，特别适用于种植义齿、套筒冠、精密附着体的转移印模制取。掌握“暂时冠及印模与模型”知识点。